精神分析学派认为，在心理地形图中，当前能被注意到的各种心理活动为
A. 想象
B. 前意识
C. 意识
D. 表象
E. 潜意识

正确答案：C。意识

解析：弗洛伊德以一种“心理地形学”的观点，将人的心理活动分成意识、前意识和潜意识三个层次（AD错）。意识（C对）是指那些在任何时刻都被知觉到的心理要素。前意识（B错）介于潜意识与意识之间，包括所有当时意识不到但在某些情况下可以意识到的那些心理要素。潜意识（E错）是指人的心理结构的深层，那些我们意识不到的，但却激发我们大多数的言语、情感和行为的原始冲动或本能欲望。